目前公认的龋病病因理论是
A. 化学细菌学说
B. 蛋白溶解学说
C. 蛋白溶解螯合学说
D. 细菌-食物-机体和时间四因素理论

正确答案：D。细菌-食物-机体和时间四因素理论

解析：本题考查龋病病因学说。目前公认的龋病病因理论是细菌-食物-机体-时间四因素理论（D对）。化学细菌学说认为龋病是寄生于牙面的产酸细菌与口腔内的碳水化合物作用产酸，作用于牙导致无机物溶解，以后蛋白水解酶溶解有机物，牙结构崩溃。其局限性是不能解释龋病从平滑面开始的原因，未提出牙菌斑概念，认为龋病是非特异性细菌引起（A错）。蛋白溶解学说阐述了龋病强调有机物的分解是龋病首发因素，无机物脱矿是继发的，具有局限性（B错）。蛋白溶解-螯合学说认为细菌破坏牙组织首先从釉质中的有机物成分开始，形成的产物具有螯合特性，形成可溶性的钙螯合物，造成无机物脱矿，龋病病损形成，尚无无证据表明（C错）。